含靛蓝、靛玉红成分的药材有
A. 侧柏叶
B. 大青叶
C. 蓼大青叶
D. 番泻叶
E. 枇杷叶

正确答案：B、C。大青叶；蓼大青叶

解析：本题考查的是大青叶与蓼大青叶的成分。含靛蓝、靛玉红成分的药材有大青叶（B对）、蓼大青叶（C对）。大青叶的成分有叶含菘蓝苷。另自植物中分离得到芥苷、新芥苷、黑芥子苷、游离吲哚醇及氧化酶、十八酸等。菘蓝苷易水解形成靛蓝、靛玉红。蓼大青叶的成分有新鲜全草含靛青苷，酸水解后生成吲哚酚，在空气中被氧化成靛蓝。另含靛玉红等。侧柏叶（A错）的成分有挥发油、黄酮类化合物以及鞣质等。番泻叶（D错）的成分有狭叶番泻叶含番泻苷A及B、番泻苷C及D、芦荟大黄素双蒽酮苷、大黄酸葡萄糖苷、芦荟大黄素葡萄糖苷及少量大黄酸、芦荟大黄素。枇杷叶（E错）的成分有皂苷、糖类、熊果酸、齐墩果酸、缩合鞣质、儿茶素、表儿茶素、逆没食子酸、槲皮素-3-葡萄糖苷等。